男，60岁，左侧腰部胀痛，伴间歇性无痛性肉眼血尿3月余，IVU可见左肾中盏充盈不全。首先考虑的疾病是
A. 肾盂癌
B. 肾盂肾炎
C. 肾黄色肉芽肿
D. 肾盏结石
E. 肾结核

正确答案：A。肾盂癌

解析：患者中老年男性，左侧腰部胀痛伴间歇性无痛性肉眼血尿3月余（肾盂癌的临床表现）。IVU（静脉肾盂造影）可见左肾中盏充盈不全，提示患者出现上尿路肿瘤，据临床表现及泌尿系造影显示，该患者最可能能的诊断是肾盂癌（A对）。肾盂肾炎（B错）临床表现为突然发生寒战、高热，伴有头痛、全身痛等，单侧或双侧腰痛，有明显的肾区压痛、肋脊角叩痛及膀胱刺激征。肾结核（E错）常见于20～40岁青壮年男性，早期无明显症状，进展期多见尿频、尿急、尿痛等临床表现，可伴终末血尿，脓尿，全身症状不明显。